某男，60岁，患热病气阴两伤之烦倦，治当补气养阴、清火生津，宜选用的药是
A. 绞股蓝
B. 刺五加
C. 白扁豆
D. 红景天
E. 西洋参

正确答案：E。西洋参

解析：本题考查的是西洋参的功效。患热病气阴两伤之烦倦，治当补气养阴、清火生津，宜选用的药是西洋参（E对）。西洋参：【功效】补气养阴，清热生津。绞股蓝（A错）：【功效】健脾益气，祛痰止咳，清热解毒。刺五加（B错）：【功效】补气健脾，益肾强腰，养心安神，活血通络。白扁豆（C错）：【功效】健脾化湿，消暑解毒。红景天（D错）：【功效】益气，平喘，活血通脉。